下列不属于未足月胎膜早破（PPROM）高危因素的是
A. 生殖道感染
B. 子宫过度膨胀
C. 前置胎盘
D. 宫颈机能不全
E. PPROM史

正确答案：C。前置胎盘

解析：未足月胎膜早破即未达到37周时临产前胎膜自然破裂，是多种因素影响的结果，常见的因素有：生殖道感染（A对）、羊膜腔压力升高、胎膜受力不均、创伤、营养不良等。前置胎盘（C错，为本题正确选项）是阴道出血（产前和产后），早产的高危因素，与胎膜早破无关。